防风不具有的功效是
A. 解痉
B. 止痛
C. 胜湿
D. 活血通络
E. 祛风解表

正确答案：D。活血通络

解析：本题考查的是防风的功效。防风不具有的功效是活血通络（D错，为本题正确答案）。防风：【功效】祛风解表（E对），胜湿（C对），止痛（B对），解痉（A对）。活血通络为徐长卿的功效。徐长卿：【功效】祛风止痛，活血通络，止痒，解蛇毒。